与心室肌相比，浦肯野细胞动作电位的主要特征是
A. 平台期时程长
B. 幅值大
C. 4期膜电位稳定
D. 4期自动除极
E. 0期除极速度快

正确答案：D。4期自动除极